组织损伤后，由其邻近的健康细胞分裂增生完成修复的过程
A. 化生
B. 机化
C. 分化
D. 再生
E. 增生

正确答案：D。再生

解析：组织损伤后，由其邻近的健康细胞分裂增生完成修复的过程是再生（D对）。化生（P9）（A错）是指一种分化成熟的细胞类型被另一种分化成熟的细胞类型所取代的过程。机化（P21）（B错）是指组织和细胞损伤后，新生肉芽组织长入并取代坏死组织、血栓、异物等的过程。分化（C错）是指同一来源的细胞逐渐产生出形态结构、功能特征各不相同的细胞类群的过程。增生（P8）（E错）是指细胞有丝分裂活跃导致组织或器官内细胞数目增多的现象。